配对设计资料采用秩和检验，若n=9，T=41，查表得T0.01（9）=1～44，T0.05（9）=5～40，T0.10（9）=8～37，则其P值为
A. P＜0.01
B. P＜0.10
C. 0.01＜P＜0.05
D. 0.05＜P＜0.10
E. P＞0.05

正确答案：C。0.01＜P＜0.05